如果某药物的使用对于孕妇及哺乳期妇女的影响尚不明确，其药品说明书应注明
A. “尚不明确”字样
B. “在医师指导下使用”字样
C. 在“执业药师指导下使用”字样
D. “未见不良反应”字样
E. “谨慎使用”字样

正确答案：A。“尚不明确”字样

解析：本题考查药品说明书。如果某药物的使用对于孕妇及哺乳期妇女的影响尚不明确，其药品说明书应注明“尚不明确”字样（A对）。处方药应当实事求是地详细列出该药品不良反应。并按不良反应的严重程度、发生的频率或症状的系统性列出；尚不清楚有无不良反应的，可在该项下以“尚不明确”来表述。